某女，55岁，面色萎黄，唇甲色淡，头晕眼花，脉细。医师辨证后处方为四物合剂。四物合剂的君药是
A. 当归
B. 阿胶
C. 川芎
D. 白芍
E. 熟地黄

正确答案：E。熟地黄

解析：本题考查的是四物合剂的药物组成与方义简释。四物合剂的君药是熟地黄（E对）。四物合剂：【方义简释】方中熟地黄质润黏腻，甘补微温，药力颇强，善补血滋阴、填精益髓，乃滋补阴血之要药，故为君药。当归（A错）甘能补润，辛温行散，善补血活血、调经止痛，既助熟地补血，又行经脉之滞，故为臣药。白芍（D错）甘补酸敛，苦微寒兼清泄，善养血柔肝、缓急止痛，与熟地黄、当归同用，则养血滋阴、和营补虚之力更著；川芎（C错）辛香行散温通，善活血行气止痛，与当归同用，能活血行滞、调经止痛。故为佐药。全方配伍，补中兼行，补血不滞血，行血不动血，共奏补血调经之功，故善治血虚所致的面色萎黄、头晕眼花、心悸气短及月经不调。阿胶（B错）并非四物合剂的药物组成成分。